含生物碱类成分的药材有
A. 山茱萸
B. 巴豆
C. 马钱子
D. 吴茱萸
E. 枸杞子

正确答案：C、D、E。马钱子；吴茱萸；枸杞子

解析：本题考查的是马钱子、吴茱萸与枸杞子的成分。含生物碱类成分的药材有马钱子（C对）、吴茱萸（D对）、枸杞子（E对）。马钱子【成分】马钱种子含总生物碱2%～5%，主要为番木鳖碱，异番木鳖碱，马钱子碱，另含微量的番木鳖次碱、伪番木鳖碱、伪马钱子碱、异马钱子碱、奴伐新碱等。吴茱萸【成分】吴茱萸含挥发油0.4%以上，油中主要成分为吴萸烯，为油的香气成分；并含罗勒烯、柠檬苦素等。尚含生物碱：吴茱萸胺（吴茱萸碱），吴茱萸次碱、羟基吴茱萸碱、吴茱萸喹酮碱、吴茱萸春等。枸杞子【成分】果实含甜菜碱约0.091%、胡萝卜素、烟酸、维生素B₁、维生素B₂、维生素C、硫胺素、抗坏血酸等。还含酸浆红素、牛磺酸、枸杞多糖等。山茱萸（A错）【成分】果实含山茱萸苷、番木鳖苷、莫诺苷、7-0-甲基莫诺苷、山茱萸新苷、马钱苷等。巴豆（B错）【成分】种仁含脂肪油（巴豆油）34%～57%，蛋白质约18%。巴豆油中含巴豆树脂，系巴豆醇、甲酸、丁酸及巴豆油酸结合而成的酯，有强烈的致泻作用。